肺硅沉着症常见的并发症是
A. 肺真菌感染
B. 肺栓塞
C. 胸膜间皮瘤
D. 肺结核
E. 肺鳞癌

正确答案：D。肺结核

解析：肺硅沉着症常见的并发症有肺结核（D对）、肺部细菌或病毒感染（A错）、慢性肺源性心脏病以及阻塞性肺气肿等。肺栓塞（B错）、胸膜间皮瘤（C错）和肺鳞癌均极少并发于肺硅沉着症。